中风左侧肢体瘫痪的患者应取
A. 左侧顶颞前斜线和顶颞后斜线
B. 右侧顶颞前斜线和顶颞后斜线
C. 右侧顶颞后斜线
D. 左侧顶颞后斜线
E. 左侧颞后线

正确答案：B。右侧顶颞前斜线和顶颞后斜线

解析：中风的治疗中，可选用头针法，选用顶颞前斜线，顶颞前斜线的上五分之一治疗对侧下肢和躯干瘫痪，中五分之二治疗上肢瘫痪，故左侧肢体瘫痪选右侧顶颞前斜线，此外顶颞后斜线的上五分之一可治疗对侧下肢和躯干的感觉异常，中五分之二治疗上肢感觉异常，可同时选取治疗。颞后线主治偏头痛、耳鸣、耳聋、眩晕，不能治疗瘫痪（B对）（ACDE错）